患者，女，24岁，面部痤疮较多，有乳胶制品过敏史，平时月经不规律，计划半年后备孕。目前宜选用的避孕方法是
A. 采用安全期避孕
B. 口服短效复方避孕药
C. 使用避孕套
D. 口服紧急避孕药
E. 放置左炔诺孕酮宫内节育系统

正确答案：B。口服短效复方避孕药

解析：本题考查女性避孕的常用方法。长期使用复方激素避孕（如＞5年）不会降低停药后12个月内的妊娠率，患者在服用短效复方避孕药（B对）后可在停药后计划备孕。患者有乳胶过敏史，故不宜使用避孕套（C错）。